普查指在一定时间内对某人群进行的调查或检查，下列哪种对象不属于普查
A. 一定范围的全体成员
B. 某居民点的全体居民
C. 某中学当天在校的全体成员
D. 某几个地区或几个单位的几个年龄组的全体成员
E. 从事某项工作的全体成员

正确答案：C。某中学当天在校的全体成员

解析：本题考查普查的概念。普查即全面调查，是指在特定时点或时期内、特定范围内的全部人群（总体）作为研究对象的调查。这个特定时点应该较短。特定范围是指某个地区或某种特征的人群。某中学当天在校的全体成员（C错，为本题正确答案）并不是总体，因此该方法不是普查。